患者，女，26岁。3天前突然发生面、颈部红肿与水疱，自觉痒痛，伴恶寒，发热，头痛，舌苔薄黄，脉滑数。怀疑接触过敏引起，治疗应首选
A. 桑菊饮
B. 银翘散
C. 普济消毒饮
D. 龙胆泻肝汤
E. 黄连解毒汤

正确答案：C。普济消毒饮

解析：接触性皮炎是指因皮肤或黏膜接触某些外界物质所引起的皮肤急性或慢性炎症反应。其特点是发病前均有明显的接触某种物质的病史。皮疹一般为红斑、肿胀、丘疹、水疱或大疱、糜烂、渗出等，一个时期内以某一种皮损为主，本病例以突发面颈部红肿与水疱，自觉痒痛为特点，怀疑接触过敏引起，故诊断为接触性皮炎，治宜清热解毒利湿：发于上部者，用消风散；发于下部者，用龙胆泻肝汤；严重者用普济消毒饮或清瘟败毒饮加减，本病例患者出现脉滑数，有邪热渐盛之势，消风散药力不够，选普济消毒饮（C对）。桑菊饮，具有疏风清热，宣肺止咳的作用，用于风温咳嗽轻证（A错）。银翘散，具有疏风清热的作用，用于疮疡焮红肿痛，邪气在表，头昏少汗，发热重、恶寒轻者（B错）。龙胆泻肝汤用于接触性皮炎发于下部者（D错）。黄连解毒汤，具有泻火解毒的作用，用于疔疮及一切火毒热毒、发热、汗出、口渴等实证（E错）。